淋病是何种类型的炎症
A. 急性化脓性炎症
B. 慢性化脓性炎症
C. 变质性炎症
D. 出血性炎
E. 浆液性炎症

正确答案：A。急性化脓性炎症

解析：淋病是由淋球菌引起的急性化脓性炎症（A对B错）。变质性炎（P66）（C错）常见于急性肝炎、流行性乙型脑炎和肠阿米巴病等。出血性炎（P76）（D错）常见于流行性出血热、钩端螺旋体病和鼠疫等。浆液性炎（P75）（E错）常见于感冒初期、渗出性结核性胸膜炎等。